伴有潜在性糖尿病的高血压患者，不宜选用
A. 哌唑嗪
B. 氢氯噻嗪
C. 卡托普利
D. 硝苯地平
E. 尼莫地平

正确答案：B。氢氯噻嗪